根据病情的轻重缓急，进行全面考虑，合理使用药物符合
A. 合理配伍细致观察
B. 节约费用公正分配
C. 对症下药剂量安全
D. 关心体贴细致入微
E. 知情同意保守医密

正确答案：A。合理配伍细致观察

解析：由于药物的两重性，医务人员在用药时要发挥其有利的治疗作用，尽量减少和避免不良反应。单种药物能治好的疾病就不联合用药，必须联合用药或使用毒副作用大的药物要根据药理性能合理配伍，以提高抗病能力，克服和对抗一些药物的毒副作用，从而使药物发挥更大的疗效（A对）。